丹毒是指
A. 多个毛囊同时感染
B. 皮肤管状淋巴管的急性炎症
C. 扩散到皮下组织的毛囊感染
D. 皮肤及其网状淋巴管的急性炎症
E. 有全身症状的毛囊及其所属皮脂腺的感染

正确答案：D。皮肤及其网状淋巴管的急性炎症

解析：西医认为丹毒是由乙型溶血性链球菌从皮肤或黏膜的细微破损处侵入皮内网状淋巴管所引起的急性炎症（D对B错）。多个毛囊同时感染（A错）、扩散到皮下组织的毛囊感染（C错）、有全身症状的毛囊及其所属皮脂腺的感染（E错）指的是痈，并不是丹毒。